有关纤维蛋白溶解药，下列叙述错误的是
A. 最严重不良反应均为出血和过敏
B. 组织型纤溶酶原激活物对血栓具有选择性
C. 尿激酶无抗原性
D. 尿激酶的出血发生率小于链激酶
E. 对形成已久的血栓难以发挥作用

正确答案：A。最严重不良反应均为出血和过敏

解析：本题考查纤维蛋白溶解药的药理作用。有关纤维蛋白溶解药，下列叙述错误的是最严重不良反应均为出血和过敏（A错，为本题正确答案）。出血也是所有溶栓药最常见的并发症，但并非所有纤维蛋白溶解药的最严重不良反应均为出血和过敏，如阿替普酶的不良反应就无过敏。组织型纤溶酶原激活物，对血栓中的纤维蛋白具有较强的亲和力，对血栓具有选择性（B对）。尿激酶是肾小球上皮细胞所产生的一种蛋白水解酶，无抗原性（C对）。尿激酶和链激酶在使用过程中都可能会引起出血倾向，尿激酶的出血发生率小于链激酶（D对）。纤维蛋白溶解药用于治疗急性血栓栓塞性疾病，对形成已久的血栓难以发挥作用（E对）。